子宫内膜癌的高危因素不包括
A. 不孕症
B. 卵巢早衰
C. 肥胖
D. 无排卵性功能失调性子宫出血
E. 糖尿病

正确答案：B。卵巢早衰

解析：子宫内膜癌的高危因素包括：无排卵性功能失调性子宫出血（D对）、多囊卵巢综合症、分泌雌激素的卵巢肿瘤（颗粒细胞瘤、卵泡膜细胞瘤）、绝经后长期服用雌激素以及长期服用他莫昔芬、肥胖（C对）、高血压、糖尿病（E对）、不孕症（A对）或不育及绝经延迟。卵巢早衰（B错，为本题正确答案）不是子宫内膜癌的高危因素。